蛇胆川贝胶囊适用于
A. 风热咳嗽
B. 肺热咳嗽
C. 风寒咳嗽
D. 阴虚咳嗽
E. 痰湿咳嗽

正确答案：B。肺热咳嗽

解析：本题考查的是蛇胆川贝胶囊的主治。蛇胆川贝胶囊适用于肺热咳嗽（B对）。蛇胆川贝胶囊：【主治】肺热咳嗽，痰多。川贝止咳露：【主治】风热咳嗽（A错），痰多上气或燥咳。杏苏止咳颗粒：【主治】风寒感冒咳嗽（C错）、气逆。养阴清肺膏：【主治】阴虚燥咳（D错），咽喉干痛，干咳少痰，或痰中带血。桂龙咳喘宁胶囊：【主治】外感风寒，痰湿内阻引起的咳嗽（E错）、气喘、痰涎壅盛；急、慢性支气管炎见上述证候者。